属于工作相关疾病的是
A. 职业性肿瘤
B. 职业有关抑郁症
C. 职业性铅中毒
D. 职业性苯中毒
E. 工伤

正确答案：B。职业有关抑郁症

解析：职业性病伤是指由职业性有害因素引起或与职业性有害因素有关的疾病及健康伤害，包括职业病、工作有关疾病和工伤（E错）。常见的工作有关疾病有：矿工的消化性溃疡；监狱警察的高血压；行政主管的冠心病；与职业有关的抑郁症（B对）、焦虑症等。职业病分为10大类132个病种，包括：①职业性尘肺病及其他呼吸系统疾病19种；②职业性皮肤病9种；③职业性眼病3种；④职业性耳鼻喉口腔疾病4种；⑤职业性化学中毒60种（如职业性铅中毒、职业性苯中毒）（CD错）；⑥物理因素所致职业病7种；⑦职业性放射性疾病11种；⑧职业性传染病5种；⑨职业性肿瘤11种；⑩其他职业病3种。